从证书号格式判断属于进口第一类医疗器械的是
A. 京械注准×××××××××××
B. 国械注准×××××××××××
C. 国械注许×××××××××××
D. 国械备××××××××

正确答案：D。国械备××××××××

解析：本题考查医疗器械注册格式与备案凭证格式。从证书号格式判断属于进口第一类医疗器械的是国械备××××××××（D对）。医疗器械注册格式与备案凭证格式：医疗器械注册证格式由国务院药品监督管理部门统一制定。注册证编号的编排方式为：×1械注×2××××3×4××5××××6。其中：×1为注册审批部门所在地的简称：境内第三类医疗器械、进口第二类、第三类医疗器械为“国”字；境内第二类医疗器械为注册审批部门所在地省、自治区、直辖市简称；×2为注册形式：“准”字适用于境内医疗器械（AB错）；“进”字适用于进口医疗器械；“许”字适用于香港、澳门、台湾地区的医疗器械（C错）；××××3为首次注册年份；×4为产品管理类别；××5为产品分类编码；××××6为首次注册流水号。延续注册的，××××3和××××6数字不变。产品管理类别调整的，应当重新编号。第一类医疗器械备案凭证编号的编排方式为：×1械备××××2××××3号。其中：×1为备案部门所在地的简称：进口第一类医疗器械为“国”字；境内第一类医疗器械为备案部门所在地省、自治区、直辖市简称加所在地设区的市级行政区域的简称（无相应设区的市级行政区域时，仅为省、自治区、直辖市的简称）；××××2为备案年份；××××3为备案流水号。